患儿，8岁。身体瘦弱，汗出较多，心烦少寐，寐后汗多，低热，口干，手足心热，唇舌色淡，脉细弱。治疗应首选
A. 人参五味子汤
B. 当归六黄汤
C. 黄芪桂枝五物汤
D. 生脉散
E. 玉屏风散

正确答案：D。生脉散

解析：患儿以汗出较多为特征，当属汗证，其气虚不能敛汗，而阴亏虚火内炽，迫津外泄而为汗，故见心烦少寐、寐后汗多、低热、口干、手足心热，舌脉亦为气阴亏虚之象，治以生脉散，可益气养阴（D对）。人参五味子汤治久嗽脾虚，中气怯弱，面白唇白者（A错）。当归六黄汤滋阴清热，固表止汗，善治盗汗，双补气阴能力较生脉散差（B错）。黄芪桂枝五物汤善于治疗营卫不调所致的汗证，症见汗出遍身而抚之不温（C错）。玉屏风散主治肺卫不固的汗证，症见头颈、胸背部汗出明显，易患外感（E错）。